下面那种情况禁用β受体阻断药
A. 心绞痛
B. 快速性心律失常
C. 高血压
D. 房室传导阻滞
E. 甲状腺功能亢进

正确答案：D。房室传导阻滞